关于普鲁卡因的错误叙述是
A. 脂溶性低
B. 对黏膜穿透力强
C. 主要用于浸润麻醉
D. 避免与磺胺药合用
E. 可引起超敏反应

正确答案：B。对黏膜穿透力强